从出生到生后28天
A. 胎儿期
B. 新生儿期
C. 婴儿期
D. 幼儿期
E. 学龄前期

正确答案：B。新生儿期

解析：本题考查小儿年龄分期。新生儿期（B对）：自胎儿娩出脐带结扎开始至生后28天内，按年龄划分，此期实际包含在婴儿期之内。